男，23岁。间断脓血便2年，大便成形或糊状，每日1～3次，有时里急后重，抗生素治疗无效。最可能的诊断是；
A. 溃疡性结肠炎
B. Crohn病
C. 慢性细菌性痢疾
D. 肠结核
E. 阿米巴肠炎

正确答案：A。溃疡性结肠炎

解析：青年男性患者，间断脓血便（黏液脓血便是溃疡性结肠炎活动期的重要表现）2年，大便每日1～3次（轻度腹泻）伴里急后重，考虑诊断为溃疡性结肠炎（A对）。Crohn病（P377）（B错）临床以腹痛、腹泻、体重下降、腹块、瘘管形成和肠梗阻为特点，脓血便较少见，多无里急后重表现。慢性细菌性痢疾（C错）有黏液脓血便及里急后重表现，但抗生素治疗有效。肠结核（P368）（D错）包括溃疡型肠结核和增生型肠结核，溃疡型肠结核常伴腹泻，多无脓血；增生型肠结核有腹部肿块，以便秘为主。阿米巴肠炎（E错）粪便中混有黏液和未消化的食物，伴有腥臭。